女，64岁。突发气急4小时，伴咳嗽、咳粉红色泡沫样痰，不能平卧。高血压病史10余年。查体：BP190/110mmHg，心率110次/分，律齐，双肺可闻干性啰音及细湿啰音。治疗措施不正确的是
A. 静注呋塞米
B. 静注美托洛尔
C. 静注硝普钠
D. 静注吗啡
E. 高流量吸氧

正确答案：B。静注美托洛尔

解析：β受体阻滞剂因其负性肌力作用，仅用于慢性心衰的治疗，禁用于急性心衰。本例突发气急，咳粉红色泡沫样痰，双肺湿啰音，应考虑急性左心衰竭。掌握“心力衰竭”知识点。